开展社区卫生服务的第一步是
A. 建立疾病和死亡原因登记报告
B. 开展危险因素干预
C. 进行调查研究
D. 建立健康档案
E. 开展慢性病的防治

正确答案：C。进行调查研究

解析：本题考查社区卫生服务的首要步骤。开展社区卫生服务的首要步骤是进行调查研究（C对ABDE错）。